以下病原体中，不含有核酸的是
A. prion
B. virion
C. viroid
D. virusoid
E. HDV

正确答案：A。prion

解析：朊粒（prion）是一种疏水性糖蛋白粒子，其主要成分是一种对蛋白酶K有抗性，不溶于去垢剂的羊瘙痒病（scrapie）朊粒蛋白PrPSC，分子量小，内含糖基化磷脂酰肌醇（GPI）成分，但不含核酸。掌握“朊粒”知识点。